牙釉质龋时下列哪项描述是正确的
A. 牙体硬组织色、形、质均发生变化
B. 牙体硬组织色、形发生变化
C. 牙体硬组织形、质发生变化
D. 牙体硬组织色、质发生变化
E. 牙体硬组织色、形、质均不发生变化

正确答案：A。牙体硬组织色、形、质均发生变化

解析：本题考查龋病的临床表现。龋病的临床表现可以概括为牙体硬组织色、形、质均发生变化（A对）以及患者感觉变化。颜色变化表现为病变部位表面粗糙、光泽消失，早期呈白垩色，进一步着色呈棕黄色或黑褐色。外形变化表现为龋洞的形成。质地改变表现为病变组织由于脱矿表现为质地松软。